鸟氨酸循环中间产物的氨基酸
A. 丙氨酸
B. 组氨酸
C. 谷氨酸
D. 精氨酸
E. 甲硫氨酸

正确答案：D。精氨酸

解析：鸟氨酸循环中间产物的氨基酸是精氨酸（D对）。丙氨酸参与葡萄糖-丙氨酸循环等（A错）。组氨酸人类的必须氨基酸之一（B错）。谷氨酸是酸性氨基酸，生物机体内氮代谢的基本氨基酸之一（C错）。甲硫氨酸参与甲硫氨酸循环等（E错）。